男，25岁。骨盆骨折伴后尿道损伤，急性尿潴留，试插尿管失败。最佳急诊处理办法
A. 针灸
B. 热敷
C. 耻骨上膀胱造瘘
D. 急症行尿道会师术
E. 急症行尿道断端吻合术

正确答案：C。耻骨上膀胱造瘘

解析：患者后尿道损伤，急性尿潴留试插尿管失败，此时最佳急诊处理办法是耻骨上膀胱造瘘（C对）引流尿液，迅速缓解尿潴留症状，若不能恢复排尿，造瘘后3个月再行尿道瘢痕切除及尿道端端吻合术。针灸（A错）和热敷（B错）只适用于动力性尿潴留。骨盆骨折出血量一般较大，常常伴有休克，不宜行急症尿道会师复位（D错）。尿道断端吻合术（E错）常为二期手术治疗方法，一期施行因未解除尿液潴留而致尿瘘，导致手术失败。